蛤蚧的主要性状特征是
A. 头略呈扁三角状，无异形大齿，吻鳞不切鼻孔
B. 腹背部呈椭圆形
C. 背部灰黑色或银灰色，有黄白色或灰绿色斑点
D. 四足均具五趾，足趾底面具吸盘
E. 尾长为体长的2倍

正确答案：A、B、C、D。头略呈扁三角状，无异形大齿，吻鳞不切鼻孔；腹背部呈椭圆形；背部灰黑色或银灰色，有黄白色或灰绿色斑点；四足均具五趾，足趾底面具吸盘

解析：本题考查的是蛤蚧药材的性状鉴别。蛤蚧的主要性状特征是头略呈扁三角状，无异形大齿，吻鳞不切鼻孔（A对）、腹背部呈椭圆形（B对）、背部灰黑色或银灰色，有黄白色或灰绿色斑点（C对）与四足均具五趾，足趾底面具吸盘（D对）。蛤蚧：【性状鉴别】药材呈扁片状，头颈部及躯干部长9～18cm，头颈部约占三分之一，腹背部宽6～11cm，尾长6～12cm（E错）。头略呈扁三角形，两眼多凹陷成窟窿，口内角质细齿，生于颚的边缘，无异型大齿。吻部半圆形，吻鳞不切鼻孔，与鼻鳞相连。腹背部呈椭圆形，腹薄。背部灰黑色或银灰色，有黄白色或灰绿色斑点或橙红色斑点散在或密集成不显著的斑纹，脊椎骨和两侧肋骨突起。四足均有5趾；趾间仅具蹼迹，足趾底面具吸盘。尾细而坚实，微现骨节，与背部颜色相同，有6～7个银灰色环带，有的再生尾较原生尾短，且银灰色环带不明显。全身密被圆形或多角形微有光泽的细鳞。气腥，味微咸。